男，70岁。排尿困难2年，腹部平片提示膀胱区有1.8cm椭圆形致密影，下一步应采取的治疗是
A. 体外冲击波碎石
B. 经尿道膀胱镜碎石
C. 药物排石
D. 膀胱切开取石
E. 大量饮水

正确答案：B。经尿道膀胱镜碎石

解析：男，70岁。排尿困难2年，腹部平片提示膀胱区有1.8cm椭圆形致密影，考虑为膀胱结石。下一步应采取的治疗是经尿道膀胱镜碎石（B对）。体外冲击波碎石（A错）常用于上尿路结石。药物排石（C错）适用于结石〈0.6cm且表面光滑。膀胱切开取石（D错）为传统的开放性手术，当结石过大、过硬或膀胱憩室病变时选用。大量饮水（E错）多用于预防结石形成。